计算患病率的分子是
A. 观察期间某病的暴露人口数
B. 观察期间某病的新旧病例数
C. 观察期间某病的新发病例数
D. 观察开始之前某病的患病人数
E. 观察期间所有人口数

正确答案：B。观察期间某病的新旧病例数

解析：患病率的分子（B对）包括调查期间被观察人群中所有的病例，包括新、旧病例，分母为被观察人群的总人口数（E错）或该人群的平均人口数。观察开始之前某病的患病人数，即为旧病例数（D错）。发病率指在一定时间内（一般为1年）、特定人群中某病新发病例出现的频率。发病率等于研究期间新发病例数除以研究其中处于风险的人口数。发病率=某期间（年）某人群中某新病例数/同期暴露人口数×k（3-4）（P28）。发病率的分子为观察期间某病的新发病例数（C错），分母为观察期间某病的暴露人口数（A错）。